体重为60kg的正常成人血浆容量约为
A. 4.8L
B. 3L
C. 4.2L
D. 6L
E. 9L

正确答案：B。3L

解析：人体内的液体总称为体液，约占体重的60%。体液可分为两部分：约2/3的体液分布在细胞内，称为细胞内液，其余的1/3分布在细胞外，称为细胞外液，包括血浆、组织液、淋巴液和脑脊液。体液约占体重的60%，体液的1/3称为细胞外液，血浆占细胞外液的1/4。因此60*0.6*（1/3）*（1/4）=3L（B对）。